被称为牙本质浅龋的是
A. 浅龋
B. 中龋
C. 深龋
D. 平滑面龋
E. 猛性龋

正确答案：B。中龋

解析：中龋：龋损的前沿位于牙本质的浅层，又称为牙本质浅龋。掌握“龋病的临床表现与分类”知识点。